泌尿系结核血尿特点是
A. 无痛性全程肉眼血尿
B. 终末血尿伴膀胱刺激征
C. 初始血尿
D. 疼痛伴血尿
E. 血红蛋白尿

正确答案：B。终末血尿伴膀胱刺激征

解析：泌尿系结核是全身结核病的一部分，其中最主要的是肾结核，肾结核绝大多数起源于肺结核，其血尿特点是终末血尿伴膀胱刺激征（B对），膀胱刺激征即尿频、尿急、尿痛，最初因含结核分枝杆菌的脓尿刺激膀胱黏膜及膀胱壁引起，以后发生结核性膀胱炎及溃疡加重膀胱刺激征并在排尿末膀胱收缩出现终末血尿。无痛性全程肉眼血尿（A错）常见于肾脏肿瘤或者输尿管肿瘤。初始血尿（C错）提示病变位于尿道。疼痛伴血尿（D错）常见于泌尿系统结石。血红蛋白尿（E错）主要见于血管内溶血，如溶血性贫血、血型不合的输血反应、阵发性睡眠性血红蛋白尿等。血尿的原因要结合其他症状进行分析。无症状的血尿应首先考虑泌尿系肿瘤的可能性；血尿伴有疼痛，尤其是伴有绞痛应考虑尿路结石；如伴有尿痛及尿流中断，应考虑膀胱结石；如伴有明显膀胱刺激症状，则以尿路感染、泌尿系结核以及膀胱肿瘤等多见。还应结合患者病史、年龄、血尿的色泽、程度等对血尿的原因进行综合判断。